心室肌细胞属于
A. 快反应自律细胞
B. 慢反应自律细胞
C. 快反应非自律细胞
D. 慢反应非自律细胞
E. 过渡细胞

正确答案：C。快反应非自律细胞